男，2岁。身高80cm，体重7.5kg，皮肤较松弛。腹部皮下脂肪约0.3cm。该小儿的营养状況属于
A. 正常
B. Ⅰ度营养不良
C. Ⅱ度营养不良
D. Ⅲ度营养不良
E. 极重度营养不良

正确答案：C。Ⅱ度营养不良

解析：Ⅰ度营养不良时，皮下脂肪0.8-0.4cm，躯干、臀部脂肪变薄，内脏无变化；Ⅱ度营养不良时，皮下脂肪＜0.4cm，胸背、四肢、臀部脂肪消失，面颊薄，消瘦明显，内脏功能降低，易感染；Ⅲ度营养不良时，全身皮下脂肪消失，内脏功能低下。题中患儿身高体重均低于平均值，皮肤松弛，提示脂肪消失，存在营养不良；腹部皮下脂肪约0.3cm。提示属于Ⅱ度营养不良（C对）。